珍珠母咸寒质重，生用、火煅用功异，其不具有的功效是
A. 凉血止血
B. 清肝明目
C. 平肝潜阳
D. 安神定惊
E. 收湿敛疮

正确答案：A。凉血止血

解析：本题考查的是珍珠母的功效。珍珠母咸寒质重，生用、火煅用功异，其不具有的功效是凉血止血（A错，为本题正确答案）。珍珠母：【功效】平肝潜阳（C对），清肝明目（B对），安神定惊（D对），收湿敛疮（E对）。凉血止血为桑叶的功效。桑叶：【功效】疏散风热，清肺润燥，平肝明目，凉血止血。